女，44岁，坐公交车突然出现心前区发闷、呼吸困难、出汗，觉得自己快不行了，不能自控，要发疯，为此感到紧张害怕，立即被送到医院急诊。未经特殊处理，半小时后症状消失，体格检查正常。该患者缓解症状长期治疗服用的药物是
A. 普萘洛尔
B. 帕罗西丁
C. 甲硫咪唑
D. 劳拉西泮
E. 阿立哌唑

正确答案：B。帕罗西丁

解析：中年女性患者，考虑诊断为惊恐发作，由于长期服用SSRis（包括帕罗西汀、氟西汀、舍曲林等）能明显降低患者的复发率，故其长期治疗服用的药物是帕罗西汀（B对）。普萘洛尔（A错）一般不用于惊恐障碍的治疗，一般用于甲亢、高血压等的治疗。他巴唑（C错）又称甲硫咪唑，是抗甲状腺药物，用于甲亢的治疗。劳拉西泮（D错）属于BZDs药物，可用于惊恐障碍的治疗，但是长期使用易导致依赖。阿立哌唑（E错）一般用于治疗精神分裂症。